先天愚型最具有诊断价值是
A. 骨路X线检查
B. 染色体检查
C. 血清T₃，T₄检查
D. 智力低下
E. 特殊面容，通贯手

正确答案：B。染色体检查

解析：先天愚型即唐氏综合症，典型病例根据特殊面容（E错）、智能与生长发育落后（D错）、皮纹特点如通贯手（E错）等不难做出临床诊断，但应根据染色体核型分析（B对）以确诊。而骨路X线检查（A错）多用于检查骨骼病变，如佝偻病、骨折等，血清T3，T4检查（C错）常用于甲状腺疾病的辅助检查，其中可通过此项检查与先天性甲状腺功能减退症相鉴别。